可产生肾损害的是
A. 普萘洛尔
B. 庆大霉素
C. 异丙肾上腺素
D. 林可霉素
E. 己烯雌酚

正确答案：B。庆大霉素

解析：本题考查庆大霉素的不良反应。庆大霉素（B对）主要不良反应为肾毒性、耳毒性。普萘洛尔（A错）为β受体阻断剂，严重不良反应可见急性心力衰竭、房室传导阻滞等。异丙肾上腺素（C错）为β受体激动剂，不良反应为心悸、头晕、皮肤潮红等。林可霉素（D错）能抑制细菌的蛋白质合成，不良反应为腹泻。己烯雌酚（E错）是人工合成的非甾体雌激素物质，长期大量应用可诱发生殖系统恶性肿瘤，孕期用药有致胎儿先天缺陷危险，女婴成年后发生阴道腺病或宫颈癌（DES综合征）的危险增加。